上消化道出血可单纯表现为呕血或黑便，也可两者兼有，这取决于
A. 原发病
B. 出血部位
C. 出血量
D. 在胃内停留时间
E. 以上均非

正确答案：C。出血量

解析：上消化道出血表现为呕血还是便血主要取决于出血的速度和出血量的多少（C对），而出血部位（B错）高低、原发病部位（A错）是相对次要的。血液在胃内停留的时间（D错）主要决定呕血或黑便的颜色深浅，时间越久，颜色越深。